抗高血压药的药理作用和临床评价
A. 塞来昔布
B. 地高辛
C. 依那普利
D. 洛伐他汀
E. 米力农

正确答案：C。依那普利

解析：本题考查依那普利。依那普利（C对）为血管紧张素转化酶抑制剂，能够降低血压，减轻心脏前后负荷，保护靶器官功能。塞来昔布（A错）为选择性COX-2环氧酶抑制剂，具有解热镇痛抗炎作用。地高辛（B错）属于强心苷类药物。洛伐他汀（D错）等羟甲基戊二酰辅酶A（HMG-CoA）还原酶抑制剂，临床用于治疗和防治动脉粥样硬化和冠心病。磷酸二脂酶抑制剂主要通过抑制磷酸二酯酶Ⅲ的活性，产生心收缩力加强和扩张血管作用。目前临床应用的有米力农（E错）及氨力农等。